金钱草是临床常用药，关于金钱草性能效用的说法，错误的是
A. 利水通淋
B. 除湿退黄
C. 解毒消肿
D. 善治肝胆结石
E. 甘淡渗利，苦寒清泄

正确答案：E。甘淡渗利，苦寒清泄

解析：本题考查的是金钱草的性能特点。金钱草甘淡渗利，咸软入肾，微寒能清（E错，为本题正确答案）。金钱草：【性能特点】本品甘淡渗利，咸软入肾，微寒能清。入肝、胆经，清利肝胆而退黄（B对）、排石；入肾与膀胱经，清热利尿而善通淋（A对）、排石；还能清热解毒而消肿疗疮。为治湿热黄疸、肝胆结石（D对）、石淋之佳品，且能清热解毒而消肿疗疮（C对），为治疮肿、蛇伤所常用。